下列各项，属随时消毒的是
A. 患者转科前的沐浴
B. 传染病学死亡患者的尸体处理
C. 传染病学室日常紫外线照射
D. SARS患者全院后对其原办公室的消毒
E. 传染病学患者转院后病室的消毒

正确答案：C。传染病学室日常紫外线照射

解析：随时消毒 对有传染源存在的地区对传染源的分泌物、排泄物，及其污染过的物品及时进行消毒。不同传染病的病原体排出途径不同、随时消毒的范围、对象和方法也不同。随时消毒是预防交叉感染的重要措施之一（C对）。